无排卵月经的临床诊断及病理特征是
A. 多见于生育年龄妇女
B. 月经量少而持续点滴状出血
C. 基础体温呈单相
D. 内膜腺上皮高柱状，有核下空泡
E. 间质细胞肥大，呈多边形

正确答案：C。基础体温呈单相

解析：无排卵月经因无孕激素分泌，故基础体温呈单相，多见于青春期及更年期妇女。掌握“功能失调性子宫出血”知识点。